患者，男性，50岁，上腹部隐痛2年，近3个月出现疼痛向腰背部放射伴间歇性黑便，体重下降。查体：贫血貌，上腹部可触及一个4cm×3cm肿块，固定。此患者最可能的诊断是
A. 胃溃疡
B. 胃癌
C. 胰腺癌
D. 胆囊结石
E. 慢性胰腺炎

正确答案：B。胃癌